检查一位面瘫患者发现其右侧鼻唇沟加深，但两侧额纹无明显差别，考虑病变部位在
A. 左面神经核上瘫
B. 右面神经核上瘫
C. 左面神经核下瘫
D. 右面神经核下瘫
E. 以上均不正确

正确答案：A。左面神经核上瘫

解析：中枢性面瘫（核上瘫）会造成病灶对侧鼻唇沟消失，病灶对侧口角低垂口角歪向病灶侧，病灶对侧不能作露齿动作，但额纹并不受影响。患者发现其右侧鼻唇沟加深，但两侧额纹无明显差别，考虑病变部位在左面神经核上瘫（A对）。